关于外周胆碱能结合相应递质后产生的作用正确的是
A. 胃肠括约肌收缩
B. 膀胱逼尿肌收缩
C. 脑血管收缩
D. 分泌黏稠唾液
E. 胆道舒张

正确答案：B。膀胱逼尿肌收缩